成釉细胞瘤X线片上典型表现为
A. 呈单房型，圆形或卵圆形
B. 骨质膨胀，骨密质消失
C. 呈多房型，房差悬殊，可含牙，牙根呈锯齿状吸收
D. 常见散在性钙化小团
E. 邻牙被推移位或脱落

正确答案：C。呈多房型，房差悬殊，可含牙，牙根呈锯齿状吸收

解析：本题考查成釉细胞瘤X线片上的典型表现。成釉细胞瘤在X线片上可表现出单房型、多房型、蜂房型和局部恶性征型。其典型表现是呈多房型，房差悬殊，边缘呈切迹状，可含牙，牙根呈锯齿状吸收（C对）。有时可见单房型，表现为圆形或卵圆形（A错），但不是典型表现。骨质膨胀，骨密质消失（B错）可以出现但并不典型，邻牙被推移位或脱落（E错），但较少见并不典型，瘤内罕见钙化，故不会散在性钙化小团（D错）。